以下有关消费者权利的表述，不符合《中华人名共和国消费者权益保护法》规定的是
A. 消费者在购买使用商品和接受服务时享有人身、财产安全不受损害的权利
B. 消费者享有知悉其购买、使用的商品或者接受的服务的真实情况的权利
C. 消费者享有自主选择商品或者服务的权利
D. 消费者在购买、使用商品或者接受服务时，享有要求回扣的权利
E. 消费者因购买、使用商品或者接受服务受到人身、财产损害的，享有依法获得赔偿的权利

正确答案：D。消费者在购买、使用商品或者接受服务时，享有要求回扣的权利

解析：本题考查消费者的权利。不符合《中华人名共和国消费者权益保护法》规定的是消费者在购买、使用商品或者接受服务时，享有要求回扣的权利（D错，为本题正确答案）。消费者的权利包括：（一）安全保障权：消费者在购买、使用商品和接受服务时享有人身、财产安全不受损害的权利（A对）。消费者有权要求经营者提供的商品和服务，符合保障人身、财产安全的要求。（二）真情知悉权：消费者享有知悉其购买、使用的商品或者接受的服务的真实情况的权利（B对）。消费者有权根据商品或者服务的不同情况，要求经营者提供商品的价格、产地、生产者、用途、性能、规格、等级、主要成分、生产日期、有效期限、检验合格证明、使用方法说明书、售后服务，或者服务的内容、规格、费用等有关情况。（三）自主选择权：消费者享有自主选择商品或者服务的权利（C对）。消费者有权自主选择提供商品或者服务的经营者，自主选择商品品种或者服务方式，自主决定购买或者不购买任何一种商品、接受或者不接受任何一项服务。消费者在自主选择商品或者服务时，有权进行比较、鉴别和挑选。（四）公平交易权：消费者享有公平交易的权利。经营者与消费者进行交易，应当遵循自愿、平等、公平、诚实信用的原则。消费者在购买商品或者接受服务时，有权获得质量保障、价格合理、计量正确等公平交易条件，有权拒绝经营者的强制交易行为。（五）获取赔偿权：消费者因购买、使用商品或者接受服务受到人身、财产损害的，享有依法获得赔偿的权利（E对）。消费者的求偿权，既包括人身损害的赔偿请求权，也包括财产损害的赔偿请求权。（六）结社权：消费者享有依法成立维护自身合法权益的社会组织的权利。（七）知识获取权：消费者享有获得有关消费和消费者权益保护方面的知识的权利。（八）受尊重权：消费者在购买、使用商品和接受服务时，享有人格尊严、民族风俗习惯得到尊重的权利，享有个人信息依法得到保护的权利。（九）监督批评权：消费者享有对商品和服务以及保护消费者权益工作进行监督的权利。消费者有权检举、控告侵害消费者权益的行为和国家机关及其工作人员在保护消费者权益工作中的违法失职行为，有权对保护消费者权益工作提出批评、建议。